代谢性碱中毒合并呼吸性碱中毒的特点是：
A. PaCO₂降低
B. HCO₃⁻浓度升高
C. SB、AB、BB均升高，AB﹤SB
D. PH明显升高，血钾浓度降低
E. 以上都是

正确答案：E。以上都是

解析：发生代谢性碱中毒合并呼吸性碱中毒时，呼吸性和代谢性因素指标均向碱性方面变化，两者无法相互代偿，导致PaCO ₂降低（A对），血浆HCO₃⁻浓度升高（B对），PH明显升高，血钾浓度降低（D对），这是由于酸中毒时由于细胞外H⁺浓度下降，细胞内K⁺流向细胞外，血浆K+浓度升高。由于血浆HCO₃⁻浓度升高，SB、AB、BB均升高，AB<SB（C对，故E为本题正确答案）。